临床上对活髓患牙进行根管治疗又称为
A. 根尖诱导成形术
B. 根管治疗术
C. 活髓切断术
D. 牙髓摘除术
E. 牙周洁治

正确答案：D。牙髓摘除术

解析：临床上对活髓患牙进行根管治疗又称为牙髓摘除术。此时的治疗操作要注意避免医源性将感染带入根管深部。掌握“根管治疗术概述”知识点。